下列药材属于二级保护野生药材物种的是
A. 甘草
B. 人参
C. 龙胆
D. 穿山甲
E. 羚羊角

正确答案：A、B、D。甘草；人参；穿山甲

解析：本题考查二级保护野生药材物种。二级保护野生药材物种名称：甘草（3个品种）（A对）、人参（B对）、穿山甲（D对）、鹿茸（马鹿）、麝香（3个品种）、熊胆（2个品种）、蟾酥（2个品种）、哈蟆油、金钱白花蛇、乌梢蛇、蕲蛇、蛤蚧、黄连（3个品种）、杜仲、厚朴（2个品种）、黄柏（2个品种）、血竭。龙胆（C错）是三级保护野生药材物种。羚羊角（E错）是一级保护野生药材物种。